医师对患者应承担的责任是
A. 彼此信任，互相协作
B. 关心，爱护，尊重患者，保护患者隐私
C. 努力消除歧视，促进医疗卫生资源的公平分配
D. 努力钻研业务，更新知识，提高专业技术水平
E. 提高道德修养水平

正确答案：B。关心，爱护，尊重患者，保护患者隐私

解析：医德基本准则医务人员在具体、典型的医学情境中应该遵循的职业行为准则，是社会对医务人员的基本道德要求，具体包括：①以人为本，救死扶伤②严谨求实，精益求精③平等交往，一视同仁④举止端庄，语言文明⑤廉洁行医，遵纪守法⑥诚实守信，保守医密⑦互尊互学，团结协作⑧乐于奉献，热心公益。以人为本，救死扶伤强调病人的中心地位；平等交往，一视同仁要求把患者摆在和医务人员平等的地位上；保守医密要求保守病人的秘密与对病人保密（不良诊断、进展等）；这就要求医务人员在医疗活动中，以患者为中心，关心，爱护，尊重患者，保护患者隐私（B对）。彼此信任，互相协作（A错）是同事、同行之间医际关系的医德准则。严谨求实，精益求精要求医务人员努力钻研业务，更新知识，提高专业技术水平（D错），是对医务人员专业技术的要求，是医务人员的专业责任。提高道德修养水平（E错）既是医师的权利，也是医师的义务，是对医务人员医德修养的要求。医疗卫生资源分配公正要求在医疗服务资源分配上遵循公平优先、兼顾效率的基本原则，达到最科学合理、社会和人民收益最大的目标，而不是简单的公平分配（C错）。